下列哪项不是引起DIC的直接原因？
A. 血管内皮细胞受损
B. 组织因子入血
C. 异物颗粒大量入血
D. 内毒素血症
E. 血液高凝状态

正确答案：E。血液高凝状态

解析：血管内皮细胞受损（A对）、组织因子入血（B对）、异物颗粒大量入血（C对）和内毒素血症（D对）均是引起DIC的直接原因。缺氧、酸中毒、抗原－抗体复合物、严重感染、内毒素等原因，均可损伤血管内皮细胞，损伤的血管内皮细胞释放组织因子，启动外源性凝血系统，启动凝血过程，引起DIC。 异物颗粒大量入血和内毒素血症也可引起DIC，蛇毒，如斑蛭蛇毒含有的两种促凝成分或在Ca让参与下激活 FX, 或可加强FV的活性，促进DIC的发生及内毒素可损伤血管内皮细胞，并刺激血管内皮细胞表达组织因子，促进DIC的发生。血液高凝状态（E错，为本题正确答案）是影响 DIC 发生发展的因素，不是引起DIC的直接原因。